心气不足，推动无力，血行不畅的常见面色是
A. 青黄
B. 萎黄
C. 青灰
D. 黧黑
E. 苍白

正确答案：C。青灰

解析：本题考查的是青色的临床意义。心气不足，推动无力，血行不畅的常见面色是青灰（C对）。望面色的临床意义：1.白色的临床意义：白色主虚寒证、失血证。白为气血不荣之候，凡阳气虚衰，气血运行无力，或耗气失血，致使气血不充，颜面俱呈白色。若白而虚浮，多属阳气不足；淡白而消瘦，多为营血亏损。若急性病突然面色苍白（E错），常属阳气暴脱的证候。里寒证剧烈腹痛，或虚寒战栗时，也可见面色苍白，则为阴寒疑滞、经脉拘急所致。2.黄色的临床意义：黄色主虚证、湿证。黄为脾虚、湿蕴的征象。故脾失健运，而气血不充，或水湿不化者，面即常见黄色。面色淡黄，枯槁无泽，称为萎黄（B错），多属脾胃气虚、营血不能上荣之故。若面色黄而虚浮，称为黄胖，多是脾气虚衰、湿邪内阻所致。如面、目、身俱黄，称为黄疸，其中黄而鲜明如橘子色者，为阳黄，多属湿热；黄而晦暗如烟熏者，为阴黄，多属寒湿。3.赤色的临床意义：主热证。赤为血色。热盛而致脉络血液充盈则面色红赤，故面赤多见于热证。若满面通红，多属外感发热，或脏腑阳盛的实热证。仅颜面部潮红，则多属阴虚而阳亢的虚热证。如久病、重病面色苍白却时而泛红如妆，多为戴阳证，是虚阳上越的危重证候。4.青色的临床意义：主寒证、痛证、瘀血证及惊风证。青为寒凝气滞、经脉瘀阻的气色。寒主收引，寒盛而留于经脉，则经脉拘急不舒，阻碍气血的运行，或气滞而凝，或血阻而瘀，都可使面色发青，甚至出现青紫色。如阴寒内盛，心腹疼痛，可见苍白而带青的面色；心气不足，推动无力，血行不畅，可见面色青灰、口唇青紫，多为气虚血瘀所致。另有小儿高热，面部青紫，以鼻柱、两眉间及口唇四周最易察见，往往是惊风的先兆。5.黑色的临床意义：主肾虚、水饮证、瘀血证。黑为阴寒水盛的病色。寒水阴邪所以过盛，主要在于肾阳的虚衰。肾为水火之脏，阳气之根。阳虚火衰，则水寒内盛，血失温养，经脉拘急，血行不畅，故面多见黑色。目眶周围见黑色，多见于肾虚水泛的水饮病，或寒湿下注的带下证。若面黑而干焦，则多为肾精久耗。黧黑（D错）为积聚瘀血内结证的症状。积聚瘀血内结证：【症状】腹部积块明显，质地较硬，固定不移，隐痛或刺痛，形体消瘦，纳谷减少，面色晦暗黧黑，面颈胸臂或有血痣赤缕，女子可见月事不下。舌质紫或有瘀斑瘀点，脉细涩。【治法】祛瘀软坚，佐以扶正健脾。【方剂应用】基础方剂为膈下逐瘀汤（五灵脂、当归、川芎、桃仁、丹皮、赤芍、乌药、延胡索、甘草、香附、红花、枳壳）合六君子汤（陈皮、半夏、茯苓、甘草、人参、白术）加减。【中成药应用】常用中成药有鳖甲煎丸、化癥回生片。青黄的临床意义，2022年考试指南未明确说明。